髋关节后脱位
A. 易发生肱动脉损伤
B. 易发生腘动脉损伤
C. 易发生缺血性骨坏死
D. 易发生桡神经损伤
E. 易发生坐骨神经损伤

正确答案：E。易发生坐骨神经损伤

解析：坐骨神经经梨状肌下孔出盆腔，走行于臀大肌深面，在坐骨结节与股骨大转子间下行至后股区。髋关节后脱位时，股骨头从髋关节囊的后下部薄弱区脱出，可造成坐骨神经损伤（E对）。肱动脉损伤（A错）多见于伸直型肱骨髁上骨折；桡神经损伤（D错）多见于肱骨干骨折；腘动脉损伤（B错）多见于股骨干下1/3骨折；缺血性骨坏死（C错）多见于股骨头下骨折和腕舟状骨骨折。